下列哪项不是病例对照研究方法的优点
A. 适用于常见病的研究
B. 应用于病因的探讨
C. 省时、省钱、省人力
D. 较易组织
E. 可以同时研究多个暴露与某种疾病的联系

正确答案：A。适用于常见病的研究

解析：本题考查病例对照研究的优点。病例对照研究的优点为：①特别适用于罕见病（A错，为本题正确答案）、潜伏期长疾病的病因研究，有时往往是罕见病病因研究的唯一选择；②相对更节省人力、物力、财力和时间（C对），并且较易于组织（D对）实施；③可以同时研究多个暴露与某种疾病的联系（E对），特别适合于探索性病因研究；④该方法应用范围广，不仅应用于病因的探讨（B对），而且广泛应用于其他健康事件的原因分析。